胆囊的位置
A. 肝脏面左纵沟前部
B. 肝脏面左纵沟后部
C. 肝裸区内
D. 肝脏面右纵沟前部
E. 肝脏面右纵沟后部

正确答案：D。肝脏面右纵沟前部

解析：胆囊位于肝脏面右纵沟前部(D对)。左纵沟前部(A错)为肝圆韧带，左纵沟后部(B错)为静脉韧带，右纵沟后部(E错)为下腔静脉。